评价饮用水氯化消毒效果是否达标的简便指标是
A. 加氯量
B. 需氯量
C. 余氯量
D. 细菌总数
E. 大肠菌群

正确答案：C。余氯量

解析：本题考查评价饮用水氯化消毒效果是否达标的简便指标。用氯及含氯化合物消毒饮用水时，为保证消毒效果，加氯量必须超过需氯量，使在氧化和杀菌后还能剩余一些有效氯，称为余氯。因此，评价饮用水氯化消毒效果是否达标的简便指标是余氯量（C对ABDE错）。